因代谢过程中苯环被氧化，生成新的手性中心的药物是
A. 普萘洛尔
B. 丙磺舒
C. 苯妥英钠
D. 华法林
E. 水杨酸

正确答案：D。华法林

解析：本题考查华法林。因代谢过程中苯环被氧化，生成新的手性中心的药物是华法林（D对）。S-（-）-华法林的主要代谢产物是7-羟基化物，而华法林的R-（+）-对映异构体的代谢产物为侧链酮基的还原产物。普萘洛尔（A错）主要在芳环的对位发生羟基化反应。丙磺舒（B错）的苯环上有多个吸电子取代基，苯环的电子云密度减少，苯环不被氧化。苯妥英（C错）在体内经过氧化反应，其中一个苯环被羟基化，生成带有手性结构的S-（-）-5-（4-羟基）化合物，并失去生物活性。